女性，11岁。上下前牙牙面自幼有白色斑块。口腔检查：上下前牙和第一磨牙牙面有边界明确的白垩色斑，其线纹与釉质的生长发育线相平行吻合。叩诊（-），探诊有带状缺陷，无松动。初步诊断为釉质发育不全。防治措施不合适的是
A. 复合树脂修复
B. 磨除、酸蚀涂层法
C. 待牙齿生长稳定后烤瓷修复
D. 进行必要的防龋处理
E. 补充维生素和矿物质

正确答案：E。补充维生素和矿物质

解析：本题考查釉质发育不全的防治原则。女性，11岁。上下前牙牙面自幼有白色斑块。口腔检查：上下前牙和第一磨牙牙面有边界明确的白垩色斑，其线纹与釉质的生长发育线相平行吻合。叩诊（-），探诊有带状缺陷，无松动。初步诊断为釉质发育不全。防治措施不合适的是补充维生素和矿物质（E错，为本题的正确答案）。釉质发育不全是在颌骨内发育矿化期间留下的缺陷，并不是牙萌出后机体健康状况的反应，对于再补充维生素和矿物质是没有意义的。釉质发育不全有牙齿色泽的改变和缺损，可通过复合树脂修复、磨除酸蚀涂层法、烤瓷冠修复等方法进行处理（ABC对）。釉质发育不全矿化较差，易磨耗，患龋后发展较快，应进行防龋处理（D对）。